药物的清除率主要与下列哪些因素有关
A. 表观分布容积
B. t1/2
C. 药物生物利用度
D. 药物与组织亲和力
E. 透过血脑屏障的能力

正确答案：A、D、E。表观分布容积；药物与组织亲和力；透过血脑屏障的能力

解析：本题考查清除率。药物的清除率主要与表观分布容积（A对）、药物与组织亲和力（D对）、透过血脑屏障的能力（E对）有关；生物半衰期t1/2（B错）、生物利用度（C错）均与药物的消除速率无关。